根据实验研究资料估计，诱发人类癌肿主要与
A. 病毒因素有关
B. 放射性因素有关
C. 化学因素有关
D. 物理因素有关
E. 遗传因素有关

正确答案：C。化学因素有关